致石棉肺的物质是
A. 石棉
B. 玻璃棉
C. 二氧化硅
D. 木粉
E. 水泥尘

正确答案：A。石棉

解析：本题考查石棉肺的诱因。石棉是天然的纤维状的硅酸盐类矿物质的总称。石棉肺是在生产过程中长期吸入石棉（A对BCDE错）粉尘所引起的以肺组织弥漫性纤维化为主的疾病。石棉肺是硅酸盐尘肺中最常见、危害最严重的一种。